脑干上属于下运动神经元的核团是
A. 副神经核
B. 黑质
C. 三叉神经中脑核
D. 迷走神经背核
E. 无

正确答案：A。副神经核

解析：下运动神经元为脑神经一般躯体和特殊内脏运动核和脊髓前角的运动神经细胞，它们的胞体和轴突构成传导运动冲动的最后公路，而副神经核（A对）属于特殊内脏运动核；黑质（B错）网状部细胞的形态、纤维联系和功能与端脑的苍白球内段相似；致密部细胞主要为多巴 胺能神经元；三叉神经中脑核（C错）属于一般躯体感觉核；迷走神经背核（D错一般内脏运动核。